男，44岁。大量饮酒后出现上腹部剧烈疼痛，伴呕吐，呕吐后腹痛不缓解。保守治疗2天，病情持续恶化，并出现休克。查体：T38.9℃，脐周及背部可见大片青紫瘀斑，上腹腹肌紧张，压痛反跳痛明显，肠鸣音减弱。为明确诊断，首选的辅助检查是
A. 腹部X线片
B. 腹部B超
C. 血常规
D. 血CA19-9
E. 肝功能

正确答案：B。腹部B超

解析：急性胰腺炎首选的辅助检查是腹部B超（B对），可发现有无胰腺肿大和胰周液体积聚，亦可发现胆道结石及胆管扩张，有助于诊断胰腺炎。腹部X片（A错）主要用于胃肠道病变的诊断，对急性胰腺炎的诊断价值不大，一般不用。血常规（C错）检查无特异性。血CA19-9（D错）目前最常用于胰腺癌的辅助诊断和术后随访。肝功能（E错）对于诊断胰腺病变无太大意义。